关于雌激素的生理作用，错误的是
A. 促进子宫发育
B. 促进水和钠的排泄
C. 促进输卵管发育
D. 促进骨钙沉积
E. 促进阴道上皮细胞增生

正确答案：B。促进水和钠的排泄